能产生核糖-5磷酸的代谢途径的是
A. 糖酵解途径
B. 三羧酸循环
C. 磷酸戊糖途径
D. 糖原合成途径
E. 糖异生途径

正确答案：C。磷酸戊糖途径

解析：本题考查糖的代谢。能产生核糖-5磷酸的代谢途径的是磷酸戊糖途径（C对）。磷酸戊糖途径是葡萄糖氧化分解的一种方式。由于此途径是由6-磷酸葡萄糖（G-6-P）开始，故亦称为己糖磷酸旁路。此途径在细胞质中进行，可分为两个阶段。第一阶段由G-6-P脱氢生成6-磷酸葡糖酸内酯开始，然后水解生成6-磷酸葡糖酸，再氧化脱羧生成5-磷酸核酮糖。NADP+是所有上述氧化反应中的电子受体。第二阶段是5-磷酸核酮糖经过一系列转酮基及转醛基反应，经过磷酸丁糖、磷酸戊糖及磷酸庚糖等中间代谢物最后生成3-磷酸甘油醛及6-磷酸果糖，后二者还可重新进入糖酵解途径而进行代谢。